运动员禁用麻黄碱的原因有
A. 可帮助人短时间内急速降低体重
B. 促使体格强壮，增强爆发力
C. 产生欣快感，能忍受紧急的伤痛，并提高攻击力
D. 刺激骨骼、肌肉和组织的生长发育
E. 提高运动员的呼吸功能，改善循环，增加供氧能力

正确答案：C、E。产生欣快感，能忍受紧急的伤痛，并提高攻击力；提高运动员的呼吸功能，改善循环，增加供氧能力

解析：本题考查麻黄碱的药理作用。麻黄碱能提高运动员的呼吸功能，改善循环，增加供氧能力（E对），并能振奋精神，产生欣快感，能忍受紧急的伤痛，并提高攻击力（C对）。